肾盂癌手术切除范围是
A. 患肾+同侧中上段输尿管
B. 患肾+同侧肾上腺
C. 患肾
D. 患肾+同侧上段输尿管
E. 患肾+同侧全长输尿管

正确答案：E。患肾+同侧全长输尿管

解析：肾盂、输尿管癌的标准手术方法是根治性肾输尿管切除术，切除范围包括患肾及同侧全长输尿管（E对），包括输尿管开口部位的膀胱壁。